以下哪一项属于医疗事故技术的鉴定原则和依据
A. 回避原则
B. 合议制原则
C. 独立鉴定原则
D. A+C
E. A+B+C

正确答案：E。A+B+C

解析：鉴定原则和依据：①合议制原则；②回避原则；③独立鉴定原则。掌握“医疗事故的技术鉴定”知识点。